睾丸和附睾
A. 睾丸上端和后缘有附睾附着
B. 睾丸表面因多次排精而形成许多瘢痕
C. 附睾除可产生精子，还可供精子营养
D. 附睾可分根、体、头3部
E. 无

正确答案：A。睾丸上端和后缘有附睾附着

解析：附睾呈新月形，紧贴睾丸上端和后缘（A对）。睾丸呈微扁的卵圆形，表面光滑（B错）。附睾分泌附睾液可供精子营养，促进精子进一步成熟，可暂时储存精子，但不能（C错）产生精子。附睾可分为头、体、尾（D错）3部分。